3095-2012）》中规定，二级标准时PM₂.₅的24小时平均浓度限值为
A. 35μg/m³
B. 75μg/m³
C. 150μg/m³
D. 200μg/m³
E. 250μg/m³

正确答案：B。75μg/m³

解析：本题考查环境空气质量标准的相关内容。我国的《环境空气质量标准（GB 3095-2012）》中规定，二级标准时PM₂.₅的24小时平均浓度限值为75μg/m³（B对ACDE错）。